治疗外阴阴道念珠菌病宜选用
A. 雌激素
B. 孕激素
C. 雄激素
D. 甲硝唑
E. 克霉唑

正确答案：E。克霉唑

解析：外阴阴道念珠菌病也称外阴阴道假丝酵母菌病，是由假丝酵母菌引起的常见外阴阴道炎症，治疗原则是根据患者情况选择局部或全身应用抗真菌药物，如咪康唑栓剂、克霉唑（E对）栓剂、制霉菌素栓剂。甲硝唑（D错）可用于滴虫性阴道炎（P248）和细菌性阴道炎（P252）的治疗。雌激素（A错）、孕激素（B错）、雄激素（C错）与外阴阴道念珠菌病发病无关，不用于其治疗。